易散失气味的饮片是
A. 大黄
B. 肉桂
C. 乳香
D. 黄芩
E. 泽泻

正确答案：B。肉桂

解析：本题考查的是中药饮片贮存中常见的质量变异现象。易散失气味的饮片是肉桂（B对）。气味散失：气味散失，是指饮片固有的气味在外界因素的影响下，或贮藏日久气味散失或变淡薄。药物固有的气味，是由其所含的各种成分决定的，主要是由挥发性物质组成，这些成分往往是治病的主要物质，如果气味散失或变淡薄，就会使药性受到影响，从而影响药效。饮片发霉、泛油、变色等，均能使其气味散失；环境温度过高，使含挥发油的药物如肉桂、沉香等，气味逐渐散失，失去油润而干枯，且温度越高挥发油挥发得越快；豆蔻、砂仁粉碎后气味会逐渐挥发散失。大黄（A错）易发生虫蛀。虫蛀，是指饮片被虫蛀蚀，从而降低疗效或失去药用价值的现象。虫蛀对中药的危害较为严重，是一种常见的质量异常现象。淀粉、糖、脂肪、蛋白质等成分，是有利于蛀虫生长繁殖的营养物质，故含上述成分较多的饮片最易生虫，如白芷、北沙参、薏苡仁、柴胡、大黄、鸡内金等。乳香（C错）易发生粘连。粘连：是指有些固体饮片，由于熔点较低，遇热则发黏而粘结在一起，或含糖分较高的饮片，吸潮后粘结在一起，使原来形态发生改变的现象。如芦荟、没药、乳香、阿魏、鹿角胶、龟甲胶、天冬、熟地等。黄芩（D错）为易发霉饮片。易发霉饮片：天冬、牛膝、独活、玉竹、黄精、白果、橘络、全瓜蒌、山茱萸、莲子心、枸杞子、大枣、马齿苋、大蓟、小蓟、大青叶、桑叶、哈蟆油、鹿筋、狗肾、水獭肝、蛤蚧、黄柏、白鲜皮、川槿皮、人参、党参、当归、知母、紫菀、菊花、红花、金银花、白及、木香、五味子、洋金花、蝼蛄、地龙、蕲蛇、蜈蚣、甘草、葛根、山柰、青皮、芡实、薏苡仁、栀子、羌活、黄芩、远志。泽泻（E错）易发生变色。变色，是指饮片的色泽起了变化，如由浅变深或由鲜变暗等。各种饮片都有其固有的色泽，这也是中药饮片检查中的主要质量标志之一。饮片变色，是由于所含色素受到外界影响（如温度和湿度、日光、霉变、化学药剂的使用、硫黄熏蒸等）使饮片失去了其原有的色泽，影响饮片质量。比如硫黄熏后，产生的二氧化硫遇水成亚硫酸，具有还原作用，可使饮片褪色；再如由于保管不善，某些饮片的颜色由浅变深，如泽泻、白芷、山药、天花粉等；有些饮片由深变浅，如黄芪、黄柏等；有些饮片由鲜艳变暗淡，如红花、菊花、金银花、梅花等花类药。因此，色泽的变化可以直接反映其内在质量。